关于大蜜丸制备要求的说法，正确的是
A. 含较多糖类及油脂等黏性药粉，用蜜量宜多
B. 含大量矿物质等黏性差的药粉，宜用嫩蜜趁热和药
C. 含较多树脂类成分的药粉，宜用80℃以上的热蜜和药。
D. 含较多纤维性或矿物质等黏性差的药粉，用蜜量宜多
E. 含麝香、冰片等挥发性药粉，宜用热蜜和药

正确答案：D。含较多纤维性或矿物质等黏性差的药粉，用蜜量宜多

解析：本题考查的是大蜜丸的制备要求。关于大蜜丸制备要求的说法，正确的是含较多纤维性或矿物质等黏性差的药粉，用蜜量宜多（D对）。蜜丸所用蜂蜜需经炼制，其目的在于除去杂质、破坏酶类、杀灭微生物、降低水分含量、增加黏性等。根据炼制程度，炼蜜有嫩蜜、中蜜（炼蜜）、老蜜三种规格，适合于不同性质的药粉制丸。①嫩蜜：炼制温度在105℃～115℃，含水量为17%～20%，相对密度约1.35，色泽无明显变化，稍有黏性。适合于含较多黏液质、胶质、糖、淀粉、油脂、动物组织等黏性较强的药粉制丸（A错）。②中蜜（又称炼蜜）：炼制温度达116℃～118℃，含水量在14%～16%，相对密度为1.37左右，炼制时表面翻腾“鱼眼泡”（黄色均匀而有光泽的气泡）。手指捻有黏性，但两指分开指间无长白丝出现。适用于黏性中等的药粉制丸，为大部分蜜丸所采用。③老蜜：炼制温度达119℃～122℃，含水量在10%以下，相对密度约为1.40，呈红棕色。炼制时表面出现“牛眼泡”（较大的红棕色气泡），能“滴水成珠”（滴入冷水呈球形而不散）。手指捻黏性强，两指分开时，有白色长丝（俗称“打白丝”）。适用于黏性差的矿物药或富含纤维的药粉制丸（B错）。冰片和麝香具有挥发性，和药时应采用温蜜（E错）以减少有效成分的损失。